女，28岁，经产妇，人工流产2次。妊娠37周，晨起发现阴道流血，多于月经量，无腹痛。查体：P80次/分，BP110/70mmHg，胎方位LOA，头浮，胎心率150次/分，耻骨联合上可闻及血管音。为明确诊断应首先进行的检查是
A. 阴道双合诊
B. 肛门指诊
C. 超声检查
D. MRI扫描
E. 催产素激惹试验（OCT）

正确答案：C。超声检查

解析：成年女性患者，经产妇，有多次流产史的高危因素。妊娠晚期（妊娠28周～40周），足起发现阴道流血，多于月经量，无腹痛。查体：血压下降，BP110/70mmHg（正常值90～120/60～80mmHg），胎位异常，头浮（提示胎先露），耻骨联合上可闻及血管音。综合患者的症状、体征和辅助检查，初步诊断为前置胎盘，为明确诊断应首先进行的检查是超声检查（C对）。阴道双合诊（A错）须在病情稳定时进行。肛门指诊（B错）主要用于肛管直肠病变的检查。MRI扫描（D错）价格较贵，部分医院不具备检查条件，适用于怀疑合并胎盘植入者。催产素激惹试验（OCT）（E错）禁忌用于前置胎盘或不明原因的产前出血者。